有关凝胶剂的错误表述是
A. 凝胶剂有单相分散系统和双相分散系统之分
B. 混悬凝胶剂属于双相分散系统
C. 卡波姆是凝胶剂的常用基质材料
D. 卡波姆溶液在pH1～5时具有最大的黏度和稠度
E. 盐类电解质可使卡波姆凝胶的黏性下降

正确答案：D。卡波姆溶液在pH1～5时具有最大的黏度和稠度